为了保护社会和其他公民的健康权益，艾滋病病毒感染者和艾滋病病人应接受（）流行病学调查和指导
A. 疾病预防控制机构
B. 卫生监督
C. 医院
D. 政府
E. 以上都可

正确答案：A。疾病预防控制机构

解析：为了保护社会和其他公民的健康权益，艾滋病病毒感染者和艾滋病病人应接受疾病预防控制机构或者出入境检验检疫机构的流行病学调查和指导。掌握“艾滋病的预防与控制、治疗与法律责任”知识点。